流行性感冒最常见的类型是
A. 单纯型
B. 肺炎型
C. 中毒型
D. 胃肠型
E. 脑炎型

正确答案：A。单纯型

解析：单纯型为流感主要临床类型（A对）。肺炎型是大流行时患者死亡的主要原因（B错）。中毒型、胃肠型、脑炎型只有少数病例有（CDE错）。